对绝大多数病例对照研究而言，它们不具有
A. 可计算发病率
B. 耗资较少
C. 可估计相对危险度
D. 估计暴露史时可能出现偏倚
E. 选择没有疾病的人口做对照

正确答案：A。可计算发病率

解析：本题考查病例对照研究的特点。病例对照研究是由果溯因的研究，在研究开始之前，患病的情况已经存在，将已经患病的人作为病例组，以无病但可比的人口作为对照组（E对），因此无法进行计算发病率（A错，为本题正确答案）。病例对照研究相比队列研究的耗费较少（B对）；病例对照研究无法直接计算相对危险度，但可以通过比值比OR来估计相对危险度的大小（C对）；病例对照研究在给暴露史时可能出现偏倚（D对）。